与溶血性贫血有关的维生素是
A. 维生素A
B. 烟酸
C. 维生素C（抗坏血酸）
D. 维生素D
E. 维生素E

正确答案：E。维生素E

解析：本题考查与溶血性贫血有关的维生素。维生素E经胎盘转运给胎儿的效率低，新生儿组织中维生素E的储备少，尤其是早产儿和低出生体重儿容易发生维生素E（E对ABCD错）缺乏，细胞膜脆性增加，容易引起溶血性贫血症。